疑有人流术后残留时，应采取的措施是
A. 清宫术
B. 取适量内膜活检
C. 测基础体温
D. 经行24-48小时刮宫
E. 分段诊刮

正确答案：A。清宫术

解析：凡疑有人流术后残留时，应采取清宫术，以防止残留物堵塞宫颈口，引起大出血（A对）。